治疗产褥期抑郁症心脾两虚证，应首选
A. 养心汤
B. 归脾汤
C. 甘麦大枣汤合归脾汤
D. 炙甘草汤
E. 桂枝加龙骨牡蛎汤

正确答案：C。甘麦大枣汤合归脾汤

解析：产褥期抑郁症心脾两虚证，治宜补益心脾，养血安神，方选甘麦大枣汤合归脾汤（C对）。养心汤（A错）为安神剂，具有养心安神之效，主治心血亏虚所致的心神不宁证。归脾汤（B错）的功效是补益气血。炙甘草汤（D错）为补益剂，具有益气滋阴，通阳复脉之效，主治阴血阳气虚弱，心脉失养证。桂枝加龙骨牡蛎汤（E错）主要功效在于调阴阳，和营卫，兼固涩精液，交通心肾，用于治疗癔病、失眠、遗精或滑经等。